神经系统中发育成熟最早，最快达成人水平的器官是
A. 视觉器官
B. 听觉器官
C. 大脑
D. 脊髓
E. 小脑

正确答案：D。脊髓